放射性骨髓炎病理变化错误的是
A. 成人较儿童对放射线更为敏感
B. 发生率与放射量的大小有关
C. 骨小梁边缘仍可见骨的沉积线
D. 早期层板骨纹理结构粗糙
E. 后期层板骨结构消失或断裂

正确答案：A。成人较儿童对放射线更为敏感

解析：放射性骨髓炎：是头颈部恶性肿瘤放射治疗的严重并发症，其发生率与放射量的大小有关。儿童可能较成人对放射线更为敏感。病理变化主要是骨的变性和坏死，可继发细菌感染。皮质骨在早期表现为层板骨纹理结构粗糙，部分骨细胞消失，骨陷窝空虚，并可见微裂。后期层板骨结构消失或断裂，骨细胞大部分消失，形成死骨。松质骨小梁萎缩，偶见骨微裂，但骨小梁边缘仍可见骨的沉积线。骨髓组织有不同程度的纤维化和炎症细胞浸润。颌骨照射区内可见小动脉内膜、内弹力层消失，肌层纤维化，外膜增厚，偶见动脉管腔内存在脱落的内皮细胞团块，或血栓形成。掌握“结核性骨髓炎及放射性骨髓炎”知识点。